类风湿关节炎患者使用下列药物时，需要同时补充叶酸的是
A. 羟氯喹
B. 来氟米特
C. 甲氨蝶呤
D. 布洛芬
E. 雷公藤

正确答案：C。甲氨蝶呤

解析：本题考查类风湿关节炎的常用药物治疗方案。RA一经确诊，应尽早使用DMARDs治疗。推荐首选甲氨蝶呤（MTX），并将它作为联合治疗的基本药物。甲氨蝶呤（C对）口服、肌注或静注均有效。多采用每周1次给药。常用剂量为7.5～25mg/w。常见的不良反应有恶心、口炎、腹泻、脱发、皮疹，少数出现骨髓抑制、听力损害和肺间质病变，也可引起流产、畸胎和影响生育力。服药期间应适当补充叶酸，定期监测血常规和肝功能。